患者，男，35岁。诊断为支原体肺炎，宜选用的抗菌药物有
A. 阿奇霉素
B. 阿莫西林
C. 阿米卡星
D. 左氧氟沙星
E. 莫西沙星

正确答案：A、D、E。阿奇霉素；左氧氟沙星；莫西沙星

解析：本题考查支原体肺炎用药。治疗支原体肺炎宜选用的抗菌药物有阿奇霉素（A对）、左氧氟沙星（D对）、莫西沙星（E对）。一般对于肺炎支原体感染适宜选用的药物是四环素类抗菌药、喹诺酮类抗菌药（左氧氟沙星、莫西沙星）、大环内酯类抗菌药（阿奇霉素）。阿莫西林（B错）为广谱青霉素，主要作用于对青霉素敏感的革兰阳性菌以及部分革兰阴性杆菌，如大肠埃希菌、奇异变形杆菌、沙门菌属、志贺菌属和流感嗜血杆菌等。阿奇霉素（A错）为氨基糖苷类抗菌药物，用于治疗需氧革兰阴性杆菌所致的严重感染，对于败血症、肺炎、脑膜炎等革兰阴性杆菌引起的严重感染，需联合应用其他对革兰阴性杆菌具有强大抗菌活性的药物，如广谱半合成青霉素类、第三代头孢菌素类及氟喹诺酮类等。